下列哪组年龄别均值曲线呈“V”形
A. 身高体重指数，身高坐高指数
B. 身高胸围指数，身高体重指数
C. 身高坐高指数，Rohrer指数
D. 握力指数，肺活量指数
E. 肺活量指数，体重指数

正确答案：C。身高坐高指数，Rohrer指数